水肿发病涉及的脏腑是
A. 心、肝、脾
B. 肝、脾、肾
C. 肺、脾、肾
D. 脾、肾、心
E. 肾、心、肺

正确答案：C。肺、脾、肾

解析：肺主一身之气，有主治节、通调水道、下输膀胱的作用。风邪犯肺，肺气失于宣畅，不能通调水道，风水相搏，发为水肿。脾主运化，有布散水精的功能。外感水湿，脾阳被困，或饮食劳倦等损及脾气，造成脾失转输，水湿内停，乃成水肿。肾主水，水液的输化有赖于肾阳的蒸化、开阖作用。久病劳欲， 损及肾脏，则肾失蒸化，开阖不利，水液泛滥肌肤，则为水肿。故水肿的病位在肺、脾、肾。（C对）（ABDE错）。